具有肝脏毒性的中药是
A. 使君子
B. 黄药子
C. 女贞子
D. 车前子
E. 牛蒡子

正确答案：B。黄药子

解析：本题考查的是中药饮片的不良反应。具有肝脏毒性的中药是黄药子（B对）。黄药子的不良反应表现：目前临床报道的与黄药子及其制剂相关的安全性问题主要是肝毒性，且有死亡病例发生。其肝损害的临床表现，以混合性损伤为主，兼有肝细胞损伤和胆汁淤积的症状，且损伤程度和剂量与给药时间有关。实验室检查血ALT、AST、STB等显著升高。一般常见症状为乏力、纳差、尿黄、头晕、厌油腻，有的伴有巩膜、皮肤黄染，瘙痒，大便灰白等，严重者表现为急性肝炎等，有的患者伴有胆囊炎。大剂量服用可引起恶心、呕吐、脱发等症状。文献报道黄药子亦可引起肾损害和甲状腺损害，临床应用过程中应注意加强监测。